男，35岁。弯腰活动后出现腰部臀部疼痛，腰部活动受限，左小腿麻木。经卧床休息半个月症状略有缓解。查体：腰部压痛，左外踝及足外侧痛觉减退，左侧踝反射减弱，左下肢直腿抬高试验（+）。最可能受累的神经是
A. L3
B. L4
C. S1
D. L2
E. L5

正确答案：C。S1

解析：患者青年男性，弯腰活动后出现腰部臀部疼痛（前屈位腰部活动受限），左小腿麻木（神经受累表现），卧床休息后症状略有缓解。腰部压痛。左外踝及足外侧痛觉减退，左侧踝反射减弱（骶1神经根受累表现）。最可能受累的神经是S1（C对）。L2（D错）的感觉区：大腿前中部。L3（A错）的感觉区：股骨内踝。L4（B错）的感觉区：内踝。L5（E错）的感觉区：第三跖趾关节背侧。S1的感觉区：足跟外侧。